关于女性乳房位置，下列叙述错误的是
A. 位于胸大肌和胸筋膜的表面
B. 上起第2~3肋
C. 下至6~7肋
D. 内侧至胸骨线
E. 无

正确答案：D。内侧至胸骨线

解析：位于胸大肌和胸筋膜的表面（A对）为女性乳房的位置，上起自第2 -3 肋（B对），下至第6 -7 肋（C对），内侧至胸骨旁线（D错为本题正确答案）。